类风湿关节炎关节僵硬变形的原因是
A. 感受风寒湿热邪气
B. 正气不足，肝肾两虚
C. 气血不行，瘀血内生
D. 气机不畅，津凝成痰
E. 痰瘀互结于关节

正确答案：E。痰瘀互结于关节

解析：类风湿性关节炎关节僵硬变形的原因是痰瘀互结于关节，经脉痹阻，痰瘀结合，不通则痛，最终出现湿热痰瘀痹阻经络，流注关节，出现骨节强直，身体屈曲，甚至畸形等表现（E对）。感受风寒湿热邪气（A错）痹阻经络，流于关节，发为本病，为本病的诱因。正气不足，肝肾两虚，外邪乘虚而入，成为发病的内在基础（B错）。气血不行，瘀血内生（C错）是产生疼痛的主要原因。气机不畅，津凝成痰（D错）出现骨节流注，关节呈进行性活动性疼痛。